哮喘持续状态是指重度哮喘发作持续时间超过
A. 8小时
B. 12小时
C. 24小时
D. 36小时
E. 48小时

正确答案：B。12小时

解析：哮喘持续状态指的是常规治疗无效的严重哮喘发作，持续时间一般在12小时以上。